细菌性痢疾的主要预防措施是
A. 隔离及治疗现症患者
B. 流行季节预防服药
C. 及时发现治疗带菌者
D. 口服痢疾活菌苗
E. 切断传播途径

正确答案：E。切断传播途径

解析：由于细菌性痢疾的传染源是患者或病原携带者，尤其是一些重要传染源，如急性非典型疾病患者和慢性患者，难以发现和管理且没有有效的免疫预防方法，而控制传播途径的方法有效，因此，细菌性痢疾的主要预防措施为切断传播途径（E对）。